拔除上颌磨牙时牙根完整的拔除，拔牙后发现口腔上颌窦瘘，但穿孔不大时
A. 立即行上颌窦瘘修补术
B. 拔牙后常规处理，待其自然愈合
C. 牙槽窝填塞碘仿纱条
D. 拔牙后常规处理，将两侧牙龈拉拢后缝合
E. 按干槽症治疗方法处理

正确答案：B。拔牙后常规处理，待其自然愈合

解析：由于上颌窦发育过大，牙根尖接近窦底，拔牙时可造成上颌窦底穿孔，小者血凝块充填，可自行愈合。掌握“牙槽外科”知识点。